初级卫生保健的基础原则不包括
A. 社区参与
B. 预防为主
C. 推广医学尖端技术
D. 合理分配资源
E. 合理转诊

正确答案：C。推广医学尖端技术

解析：初级卫生保健是最基本的、人人都能得到的、体现社会平等权利的、人民群众和政府都能负担得起的基本卫生保健服务。初级卫生工作者提供或使用的必需是既科学又易于推广、适合当地社会经济发展水平、且能为广大群众所接受的技术和方法，而不是医学尖端技术（C错，为本题正确答案）。卫生资源的合理配置是保障卫生保健服务公平性的关键（D对）。初级卫生保健的重点是预防疾病和促进健康，而不仅仅是治疗服务（B对）。